我国现行饮用水卫生标准规定，菌落总数应为
A. ＜1000CFU/ml
B. ＜100CFU/ml
C. ＜50CFU/ml
D. ＜10CFU/ml
E. ＜3CFU/ml

正确答案：B。＜100CFU/ml

解析：本题考查我国现行饮用水卫生标准规定的菌落总数。菌落总数是评价水质清洁度和考核净化效果的指标。菌落总数增多说明水受到了微生物污染，但不能识别其来源，必须结合总大肠菌群指标来判断污染来源及安全程度。我国现行饮用水卫生标准规定菌落总数＜100CFU/ml（B对ACDE错）。